男，17岁。骑摩托车时不慎摔倒，左颅顶着力，短暂昏迷后清醒。伤后30分钟送医院，急诊头颅CT示左颅顶颅骨骨折。2小时后头痛加剧，逐渐昏迷，左侧瞳孔散大，右侧肢体瘫痪。为明确诊断，应首选的检查是
A. 颅骨以及颈部正侧位X线片
B. 颈部CT
C. 头颅MRI
D. 脑电图
E. 头颅CT

正确答案：E。头颅CT

解析：青少年男性患者，头部外伤，短暂昏迷后清醒，之后再次陷入昏迷（急性硬膜外血肿的典型表现），左侧瞳孔散大，右侧肢体瘫痪（提示左侧小脑幕切迹疝），急诊头颅CT示左颞顶颅骨骨折（提示有颅内血肿的可能），结合患者病史、临床表现和影像学检查，应诊断为左颞顶急性硬膜外血肿合并小脑幕切迹疝。为明确诊断，首选的检查为头颅CT（E对），CT扫描不仅可以直接显示颅骨内板与硬脑膜之间呈双凸镜形或弓形的硬脑膜外血肿，还可了解脑室受压和中线结构移位的程度等情况，对疾病的诊断和治疗具有重要意义。颅骨以及颈部正侧位X线片（A错）主要用于颅盖骨及颈椎骨折的诊断。颈部CT（B错）可用于诊断颈椎骨折，但对于颅内血肿无诊断价值。头颅MRI（C错）对颅内软组织显像效果较好，主要用于颅脑肿瘤的诊断，对颅内血肿的显示效果不佳，故排除。脑电图（D错）主要用于癫痫及精神性疾病的的诊断。